女，35岁，停经3个月，阴道不规则流血3天，妇科检查子宫如4个月妊娠大小，B超显示宫腔内落雪征，首先考虑
A. 葡萄胎
B. 双胎妊娠
C. 妊娠合并子宫肌瘤
D. 自然流产
E. 羊水过多

正确答案：A。葡萄胎

解析：患者为育龄期妇女，停经3个月（疑为早孕），阴道不规则流血3天（葡萄胎患者一般在停经8～12周左右开始不规则阴道流血，量多少不定），妇检：子宫如4个月妊娠大小（因葡萄胎迅速增长及宫腔内出血，约半数以上患者的子宫大于停经月份），B超显示宫腔内落雪征（完全性葡萄胎的典型超声图像为子宫大于相应孕周，无妊娠囊或胎心搏动，宫腔内充满不均质密集状或短条状回声，呈“落雪状”，水泡较大时则呈“蜂窝状”），首先考虑为葡萄胎（A对）。自然流产（D错）主要特征为停经后阴道流血和腹痛，但子宫大小与停经周数基本相符或小于停经周数。双胎妊娠（B错）和妊娠合并子宫肌瘤（C错），妊娠早期无阴道不规则流血，B超检查无“落雪征”，而且前者B超可见宫腔内两个妊娠囊，后者B超可明确肌瘤的大小、位置、数目。羊水过多（E错）多发生于妊娠晚期，孕妇常无明显不适，B超可直接测量羊水量明确诊断。